不得发布广告的是
A. 基本药物
B. 非处方药
C. 医疗机构配制的制剂
D. 处方药

正确答案：C。医疗机构配制的制剂

解析：本题考查不得发布广告的产品。不得发布广告的是医疗机构配制的制剂（C对）。不得发布广告的产品：按照规定，不得做广告的产品包括：①麻醉药品、精神药品、医疗用毒性药品、放射性药品、药品类易制毒化学品，以及戒毒治疗的药品、医疗器械；②军队特需药品、军队医疗机构配制的制剂；③医疗机构配制的制剂；④依法停止或者禁止生产、销售或者使用的药品、医疗器械、保健食品和特殊医学用途配方食品；⑤法律、行政法规禁止发布广告的情形。药品广告的内容应当以国务院药品监督管理部门核准的说明书为准。药品广告涉及药品名称、药品适应症或者功能主治、药理作用等内容的，不得超出说明书范围。药品广告应当显著标明禁忌、不良反应，处方药（D错）广告还应当显著标明“本广告仅供医学药学专业人士阅读”，非处方药（B错）广告还应当显著标明非处方药标识（OTC）和“请按药品说明书或者在药师指导下购买和使用”。